主含皂苷类成分的药材有
A. 三七
B. 柴胡
C. 延胡索
D. 远志
E. 知母

正确答案：A、B、E。三七；柴胡；知母

解析：本题考查的是含有皂苷成分的药材。主含皂苷类成分的药材分有三七（A对）、柴胡（B对）与知母（E对）。三七中主要化学成分是三萜皂苷类，含量高达12%。《中国药典》以人参皂苷Rg₁、人参皂苷Rb₁及三七皂苷R₁为指标成分进行含量测定，要求三者总量不得少于5.0%。柴胡中含有的总皂苷为1.6%～3.8%。柴胡中所含皂苷均为三萜皂苷，柴胡皂苷是柴胡的主要有效成分。《中国药典》以柴胡皂苷a和柴胡皂苷d为指标成分对柴胡药材进行含量测定。要求两者的总含量不少于0.30%。知母中的化学成分主要为甾体皂苷和芒果苷，还含有木脂素、甾醇、鞣质、胆碱等成分。《中国药典》上将知母皂苷BⅡ和芒果苷定为知母药材的质量控制成分，要求知母皂苷BⅡ含量不得少于3.0%，芒果苷的含量不得少于0.7%。饮片指标低于原药材，如蓝知母要求知母皂苷BⅡ含量不得少于2.0%，芒果苷含量不得少于0.40%。延胡索（C错）延胡索含有多种苄基异喹啉类生物碱，包括延胡索甲素、延胡索乙素和去氢延胡索甲素等，这些生物碱的类型为原小檗碱型、原托品碱型、阿朴菲型等六种异喹啉型生物碱，其中多数属原小檗碱型。《中国药典》以延胡索乙素为指标成分进行含量测定，要求含量不得少于0.050%。远志（D错）的化学成分，2022年考试指南未明确说明。